热邪犯胃所致呕吐的特点是
A. 呕声壮厉，吐黏稠黄水
B. 呕吐呈喷射状
C. 呕吐酸腐食糜
D. 吐势徐缓，声音微弱
E. 呕吐物清稀

正确答案：A。呕声壮厉，吐黏稠黄水

解析：邪热犯胃，胃失和降，胃气上逆所致的呕吐，吐势较猛，声音壮厉，呕吐出黏稠黄水，或酸或苦者，多属实热证（A对）。呕吐呈喷射状者，多为热扰神明，或因头颅外伤，或因脑髓有病等（B错）。呕吐酸腐味食物，多属伤食。多因暴饮暴食，或过食肥甘厚味，损伤脾胃，食滞胃脘，胃失和降，胃气上逆所致（C错）。吐势徐缓，声音微弱，呕吐物清稀者，多属虚寒证。常因脾胃阳虚，脾失健运，胃失和降，胃气上逆所致（DE错）。